头孢菌素3-位取代基的改造，可以
A. 扩大抗菌谱，提高抗菌活性
B. 增加对β-内酰胺酶的稳定性
C. 对抗菌活性有较大影响
D. 明显改善抗菌活性和药物代谢动力学性质
E. 不引起交叉过敏反应

正确答案：D。明显改善抗菌活性和药物代谢动力学性质

解析：本题考查头孢菌素类抗菌药。头孢菌素3位取代基的改造可明显的改变抗菌活性和药物动力学性质（D对C错）。头孢菌素7位的酰胺基是抗菌谱的决定性基团，对扩大抗菌谱提高抗菌活性有至关重要的作用（A错）；用α-甲氧基替代7α-氢原子可增加对β-内酰胺酶的稳定性（B错）；头孢菌素3位取代基的改造仍会发生交叉过敏反应，如对青霉素过敏（E错）。